左侧小脑幕切迹疝最确切的解释是
A. 左侧基底节受压左移
B. 脑干受压左移
C. 左侧颞叶钩回通过小脑幕切迹被推挤至幕下
D. 左侧小脑幕的移位
E. 左侧小脑幕挤压脑干

正确答案：C。左侧颞叶钩回通过小脑幕切迹被推挤至幕下

解析：左侧小脑幕切迹疝最确切的解释是左侧颞叶钩回通过小脑幕切迹被推挤至幕下（C对）。左侧基底节受压左移（A错）、脑干受压左移动（B错）、左侧小脑幕的移位（D错）、左侧小脑幕挤压脑干（E错）均不是左侧小脑幕切迹疝发生部位。